下列关于精神分析学派说法不正确的是
A. 精神分析学派的心理结构分为三个层次依次为：潜意识、前意识、意识
B. 精神分析学派的人格结构分为三个部分：本我、自我、超我
C. 精神分析学派的心理发展婴儿期是肛欲期
D. 学前期是崇拜性器期
E. 青少年期为潜伏期

正确答案：C。精神分析学派的心理发展婴儿期是肛欲期

解析：婴儿期是口欲期，幼儿期是肛欲期。掌握“心理治疗的理论基础”知识点。